《素问·咳论》认为与咳关系最密切的脏腑是
A. 肾
B. 大肠
C. 肺
D. 胃
E. 脾

正确答案：C。肺

解析：“五脏各以其时受病，非其时，各传以与之”的理论，指出各季节之淫气，乘主时之五脏，而传与肺（C对）。